男性，18岁，自幼有哮喘，每年春季发作，用沙丁胺醇可缓解。今在公园春游时突感胸闷气急。经治疗患者症状缓解，为探讨病因宜做哪项检查
A. 纤维支气管镜检查
B. 血清特异性IgE测定
C. 血嗜酸性粒细胞测定
D. 肺功能测定
E. 气道反应性测定

正确答案：B。血清特异性IgE测定